不属于变异指标的是
A. 中位数
B. 标准差
C. 全距
D. 四分位差
E. 平均差

正确答案：A。中位数

解析：用于描述集中趋势的指标有算数均数、几何均数和中位数（A错，为本题正确答案）。用于描述变异程度的指标有大体可以分为两类：一类是按间距计算，有全距（C对）和四分差（四分位数间距）（D对）；另一类按平均差距计算，有平均差（E对）、方差、标准差（B对）和变异系数等。